患者，女性，42岁，舌苔部有一红色斑块一年余，病损时常变换位置，无自觉症状。该患者可能出现哪项症状
A. 自发性疼痛
B. 舌体活动不自如
C. 剥脱区微凹陷
D. 有明显的刺激性痛
E. 菌状乳头不清晰

正确答案：C。剥脱区微凹陷

解析：本题考查游走性舌炎的临床表现。患者，女性，42岁（中年女性），舌苔部有一红色斑块一年余（病损黏膜发红），病损时常变换位置（病变位置变化），无自觉症状，综合考虑诊断为游走性舌炎。该患者可能出现剥脱区微凹陷（C对）。游走性舌炎的病损由周边区和中央区组成，中央区表现为丝状乳头（E错）萎缩呈剥脱样，黏膜表面光滑、充血发红且微凹。周边区表现为丝状乳头增厚、呈黄白色条带状或弧线状分布。游走性舌炎患者一般无疼痛（AD错）等不适感觉，若合并真菌或细菌感染，食用刺激性食物或饮料时会有烧灼样疼痛或钝痛。游走性舌炎一般不会影响患者舌头活动度（B错）。